确定对某些传染病接触者检疫或医学观察的主要依据是该传染病的
A. 临床症状期
B. 病原携带期
C. 传染期
D. 恢复期
E. 潜伏期

正确答案：E。潜伏期

解析：潜伏期（E对）是指病原体侵入人体至最早出现临床症状的这段时间，不同的潜伏期长短不同，有的疾病短至几小时，有的则长达数年，但同一种传染病有相对固定的潜伏期。临床症状期（A错）、病原携带期（B错）、传染期（C错）、恢复期（D错）已经出现症状，不是对某些传染病接触者检疫或医学观察的主要依据。